禁用于肾功能不全患者的抗菌药物是
A. 青霉素G
B. 阿莫西林
C. 头孢曲松
D. 阿米卡星
E. 阿奇霉素

正确答案：D。阿米卡星

解析：氨基糖苷类抗生素（阿米卡星）（D对）禁用于肾功能不全的患者，此类药物虽然经肾小球滤过，但对肾组织有极高的亲和力，通过细胞膜吞饮方式而大量积聚在肾皮质，导致肾小管、尤其是近曲小管上皮细胞溶酶体破裂，线粒体损害，轻则引起肾小管肿胀，重则产生急性坏死，因此肾功能不全患者禁用于阿米卡星。青霉素G、阿莫西林、头孢曲松肾损害很小甚至无肾毒性，可应用于肾功能不全的患者（ABC错）。阿奇霉素（E错）不良反应轻，绝大多数患者均能耐受，轻、中度肝肾功能不全者可以应用。